生命活动的主宰及其总体的外在表现是
A. 精
B. 气
C. 津液
D. 神
E. 血

正确答案：D。神

解析：人体之神有广义、狭义之分。广义之神，指人体生命活动的主宰及其外在总体表现的统称（D对），包括形色、眼神、言谈、表情、应答、举止、精神、情志、声息、脉象等方面；狭义之神，指意识、思维、情志等精神活动。精是构成和维持人体生命活动的最基本物质，对于人体生命活动具有重要意义，故《素问·金匮真言论》说：“夫精者，身之本也”（A错）。气是人体内活力很强、运动不息的极细微物质，是构成和维持人体生命活动的基本物质（B错）。血，即血液，是行于脉中，循环流注于全身，具有营养和滋润作用的红色液态物质《素问·调经论》说：“人之所有者，血与气耳”（E错）。津液，是津和液的合称，指人体的正常水液，包括脏腑、形体、官窍的内在液体及其正常的分泌物（C错）。